由逍遥散变化为黑逍遥散，属于
A. 药味加减的变化
B. 药量增减的变化
C. 剂型更换的变化
D. 药味加减和药量增减变化的联合运用
E. 药量增减和剂型更换变化的联合运用

正确答案：A。药味加减的变化

解析：逍遥散组成是甘草、当归、茯苓、芍药、白术、柴胡、生姜、薄荷。黑逍遥散是逍遥散加生地或熟地，属于药味加减（A对）。